房水回流途经
A. 结膜囊
B. 巩膜静脉窦
C. 泪囊
D. 玻璃体
E. 以上都不是

正确答案：B。巩膜静脉窦

解析：房水回流途经巩膜静脉窦（B对）。